吲哚美辛（消炎痛）具有
A. 镇痛作用
B. 抗炎作用
C. 两者皆有
D. 两者皆无

正确答案：C。两者皆有

解析：本题考查吲哚美辛。吲哚美辛（消炎痛）为芳基乙酸类非甾体类抗炎药，其抗炎及镇痛（C对）作用强。